某医院为节省开支，将医疗废物交给一个体废品收购站处置，受到当地卫生行政部门的处罚。理由是医院
A. 未对医疗废物进行登记
B. 对医疗废物的处置不符合国家规定的环境保护规范
C. 未执行危险废物转移联单管理制度
D. 将医疗废物交给未取得经营许可证的单位或者个人收集、处置
E. 未设置医疗废物监控部门

正确答案：D。将医疗废物交给未取得经营许可证的单位或者个人收集、处置